检查休克型中毒型细菌性痢疾，不恰当的措施为
A. 使用血管活性药物
B. 脱水
C. 扩容
D. 使用抗生素
E. 纠正酸中毒

正确答案：B。脱水

解析：休克型中毒型细菌性痢疾主要表现为感染性休克，早期为微循环障碍，可见精神萎靡，面色灰白之四肢厥冷，脉细速、呼吸急促，血压正常或偏低，脉压小，后期微循环瘀血、缺氧、口唇及甲床发绀、皮肤花斑、血压下降或测不出，可伴心、肺、血液、肾脏等多系统功能障碍。此时需要扩容（C对）以迅速补充血容量，使用血管活性药物（A对）纠正休克，使用抗生素（D对）防止感染，纠正代谢性酸中毒等酸碱平衡紊乱，而不是脱水治疗（B错，为本题正确答案）。